血液pH小于以下何种数值时，心肌收缩力降低
A. 7.6
B. 7.1
C. 7.5
D. 7.4
E. 7.2

正确答案：E。7.2

解析：酸中毒还可引起肾上腺髓质释放肾上腺素，从而发挥其对心脏的正性肌力作用，但酸中毒严重时又可阻断肾上腺素对心脏作用，而引起心肌收缩力减弱，心肌弛缓，心输出量减少。pH<7.2时，则因肾上腺素的作用被阻断而使心肌收缩力减弱（E对）。